能与3,5-二硝基苯甲酸碱性醇溶液反应的是
A. 柠檬烯
B. 鱼腥草素
C. 龙胆苦苷
D. 新穿心莲内酯
E. 丁香酚

正确答案：D。新穿心莲内酯

解析：本题考查的是穿心莲的主要化学成分及其结构。能与3,5-二硝基苯甲酸碱性醇溶液反应的是新穿心莲内酯（D对）。穿心莲叶中含有多种二萜内酯及二萜内酯苷类成分，如穿心莲内酯、新穿心莲内酯、14-去氧穿心莲内酯、脱水穿心莲内酯等。其中穿心莲内酯含量最高，为其主要活性成分。新穿心莲内酯的内酯环具有活性亚甲基反应，可与Legal试剂、Kedde试剂等反应显紫红色。Kedde反应：又称3,5-二硝基苯甲酸试剂反应。取样品的甲醇或乙醇溶液于试管中，加入3,5-二硝基苯甲酸试剂（A液：2%的3,5-二硝基苯甲酸甲醇或乙醇溶液；B液：2mol/L氢氧化钾溶液，用前等量混合）3～4滴，溶液呈红色或紫红色。本试剂可用于强心苷纸色谱和薄层色谱显色剂，喷雾后显紫红色，几分钟后褪色柠檬烯（A错）属于挥发油，为薄荷、莪术、荆芥、枳壳等中药的主要化学成分之一。鱼腥草素（B错）属于挥发油中的脂肪族化合物，为鱼腥草挥发油的化学成分之一。龙胆苦苷（C错）属于裂环环烯醚萜苷为龙胆的主要化学成分之一。龙胆含有的主要有效成分为裂环环烯醚萜苷类化合物，如獐牙菜苷、獐牙菜苦苷和龙胆苦苷等。此外还含有生物碱、黄酮、香豆素及内酯等化合物。《中国药典》以龙胆苦苷为指标成分进行含量测定，龙胆中含量不得少于3.0%；坚龙胆中含量不得少于1.5%。丁香酚（E错）属于挥发油中的单萜类衍生物，为艾叶的主要化学成分之一。艾叶的化学成分主要有挥发油、黄酮和三萜类成分。其中艾叶含挥发油0.45%～1.00%，《中国药典》以桉油精（桉叶素）和龙脑为指标成分，采用气相色谱法进行含量测定，要求桉油精不得少于0.050%，含龙脑不得少于0.020%。艾叶挥发油主要包括单萜类化合物、单萜类衍生物、倍半萜类化合物及其衍生物，其中30种单萜类衍生物占挥发油的79.20%，是艾叶挥发油的主要组成部分，包括1,8-桉树脑、茨烯、香桧烯、1-辛烯-3-醇、樟脑、α-松油醇、丁香酚等。